输注卡铂时应选用的溶剂是
A. 乳酸钠林格注射液
B. 5%葡萄糖注射液
C. 10%氯化钠注射液
D. 0.9%氯化钠注射液
E. 4%碳酸氢钠注射液

正确答案：B。5%葡萄糖注射液

解析：本题考查药物溶剂。卡铂的使用方法是：用5％葡萄糖注射液（B对）溶解，浓度为10mg/ml，再加入5％葡萄糖注射液250～500ml中静脉滴注。奥沙利铂的使用方法是：先用注射用水或5%葡萄糖注射液10～20ml溶解，加入5%葡萄糖注射液250～5OOml静滴2小时。乳酸钠林格注射液（A错）用于代谢性酸中毒或有代谢性酸中毒的脱水病例，而不是用于铂类的溶剂。氯化钠可用于等渗性失水，当血钠回升至120～125mmol/L以上，可改用等渗溶液或等渗溶液中酌情加入高渗葡萄糖注射液或10%氯化钠注射液（C错）。顺铂的使用方法是：用0.9%氯化钠注射液（D错）或5%葡萄糖注射液稀释。碳酸氢钠注射液（E错）用于治疗代谢性酸中毒、碱化尿液等。也可作为制酸药，治疗胃酸过多引起的症状。